经典型PKU浓度应大于
A. 1200μmol/L
B. 1100μmol/L
C. 1500μmol/L
D. 1000μmol/L
E. 1700μmol/L

正确答案：A。1200μmol/L

解析：苯丙氨酸测定是诊断苯丙酮尿症的常用方法，正常浓度小于120μmol/L，经典型PKU＞1200μmol/L（A对）。